黄酮类化合物的基本碳架为
A. C₆-C₁-C₆
B. C₆-C₂-C₆
C. C₆-C₃-C₆
D. C₆-C₄-C₆
E. C₆-C₅-C₆

正确答案：C。C₆-C₃-C₆

解析：本题考查的是黄酮类化合物的结构。黄酮类化合物的基本碳架为C6-C3-C6（C对）。根据中央三碳链的氧化程度、B-环联接位置（2-或3-位）以及三碳链是否成环等特点，可将中药中主要的黄酮类化合物分类。